槟榔善杀
A. 蛔虫
B. 蛲虫
C. 绦虫
D. 钩虫
E. 阴道滴虫

正确答案：C。绦虫

解析：本题考查的是槟榔的性能特点。槟榔善杀绦虫（C对）。槟榔：【性能特点】本品质重苦降，辛散温通，入胃与大肠经。善杀虫而力强，兼缓泻而促排虫体，治多种寄生虫病，最宜绦虫病、姜片虫病者。能消积、行气、利水、截疟，治腹胀便秘、泻痢后重、水肿、脚气及疟疾。【主治病证】（1）绦虫病，姜片虫病，蛔虫病（A错），蛲虫病（B错），钩虫病（D错）等。（2）食积气滞之腹胀、便秘，泻痢里急后重。（3）水肿，脚气浮肿。（4）疟疾。鸦胆子：【性能特点】本品苦寒清解，有小毒，力较强，入肝、大肠经。既清解热毒，又燥湿杀虫而止痢、截疟。杀多种人体寄生虫，既杀阿米巴原虫，又杀多种肠道寄生虫、血吸虫、阴道滴虫（E错）等。且善腐蚀，外用蚀赘疣、鸡眼、瘢痕，内服要注意保护消化道黏膜。力强效佳，虽可治各种痢疾，但多用于休息痢（阿米巴痢疾）。【主治病证】（1）休息痢（阿米巴痢疾），热毒血痢。（2）疟疾。（3）赘疣，鸡眼（外用）。